关于药材粉碎，以下正确的是
A. 湿法粉碎常用“加液研磨法”和“水飞法”
B. “油”适合粉碎含油脂性药材物
C. “串料”适合粉碎含黏性药材
D. 超微粉碎适用于有效成分容易浸出药材
E. 干法粉碎分为单独粉碎和混合粉碎

正确答案：A、B、C、E。湿法粉碎常用“加液研磨法”和“水飞法”；“油”适合粉碎含油脂性药材物；“串料”适合粉碎含黏性药材；干法粉碎分为单独粉碎和混合粉碎

解析：本题考查药材粉碎的方法。关于药材粉碎，以下正确的是湿法粉碎常用“加液研磨法”和“水飞法”（A对）；“油”适合粉碎含油脂性药材物（B对）；“串料”适合粉碎含黏性药材（C对）；干法粉碎分为单独粉碎和混合粉碎（E对）。湿法粉碎系指往药物中加入适量水或其他液体并与之一起研磨粉碎的方法（即加液研磨法）。通常选用液体是以药物遇湿不膨胀、两者不起变化、不妨碍药效为原则。樟脑、冰片、薄荷脑等常加入少量液体（如乙醇、水）研磨；朱砂、珍珠、炉甘石等采用传统的水飞法，亦属此类。串油粉碎：先将处方中其他中药粉碎成粗粉，再将含有大量油脂性成分的中药陆续掺人，逐步粉碎成所需粒度，或将油脂类中药研成糊状再与其他药物粗粉混合粉碎成所需粒度。需串油粉碎的中药主要是种子类药物，如桃仁、苦杏仁、苏子、酸枣仁、火麻仁、核桃仁等。串料粉碎：先将处方中其他中药粉碎成粗粉，再将含有大量糖分、树脂、树胶、黏液质的中药陆续掺入，逐步粉碎成所需粒度。需要串料粉碎的中药有乳香、没药、黄精、玉竹、熟地、山萸肉、枸杞、麦冬、天冬等。干法粉碎系指将药物经适当干燥，使药物中的水分降低到一定限度（一般应少于5%）再粉碎的方法。干法粉碎分为单独粉碎和混合粉碎。超微粉碎又称超细粉碎，是指将粉粒物料磨碎到粒径为微米级以下的操作。超微粉体又称超细粉体，通常分为微米级、亚微米级以及纳米级粉体（D错）。